男，46岁，聚合釜清釜工。工作中突然出现意识模糊、四肢无力，继而昏迷。入院急诊查体：口腔有粉红泡沫状分泌物溢出，口唇发绀，双侧瞳孔等大等圆，对光反应减弱，两肺可闻及湿啰音，心率110次/min。该患者最可能是哪种毒物中毒
A. 苯胺
B. 氯乙烯
C. 正已烷
D. 甲苯
E. 氯气

正确答案：B。氯乙烯